肾母细胞瘤临床表现的特点是
A. 血尿
B. 腹痛
C. 腹部包块
D. 发热
E. 贫血

正确答案：C。腹部包块

解析：肾母细胞瘤最常见最重要的临床特点是腹部包块（C对）。血尿（A错）、腹痛（B错）、发热（D错）、贫血（E错）、消瘦、恶心、呕吐等为肾母细胞瘤的一般表现，还可见于其他类型的肾肿瘤。